某战士参加野营拉练归来途中自觉右小腿疼痛，经休息治疗2周后无好转，拍X线片检查发现右腓骨下段横行骨折线，无移位，其骨折的主要成因是
A. 直接暴力
B. 积累性劳损
C. 间接暴力
D. 肌拉力
E. 骨髓炎

正确答案：B。积累性劳损

解析：骨折的成因包括直接暴力、间接暴力和疲劳性骨折（积累性劳损）。患者野营拉练后出现右腓骨下段横行骨折，骨折的主要成因是积累性劳损（B对）。积累性劳损是指长期、反复、轻微的直接或间接外力可致使肢体某一特定部位骨折，如远距离行军易致第2、3跖骨及腓骨下1/3骨干骨折。直接暴力（A错）是指暴力直接作用使受伤部位发生骨折，常伴有不同程度的软组织损伤。如小腿受到撞击，于撞击处发生胫腓骨骨干骨折。间接暴力（C错）是指暴力通过传导、杠杆、旋转和肌收缩使肢体受力部位的远处发生骨折，包括肌拉力（D错）导致的骨折，如骤然跪倒时，股四头肌收缩导致髌骨骨折。骨髓炎（E错）多由感染或外伤引起。